痛风急性发作期，为抑制粒细胞浸润可选用
A. 别嘌醇
B. 秋水仙碱
C. 泼尼松龙
D. 苯溴马隆
E. 双氯芬酸

正确答案：B。秋水仙碱

解析：本题考查痛风治疗药。痛风急性发作期，为抑制粒细胞浸润可选用秋水仙碱（B对）。别嘌醇（A错）是目前常用抑制尿酸生成的药物，是慢性痛风和痛风性肾病的首选药。波尼松龙（C错）用于痛风急性期发作的治疗，但停药后易复发。苯溴马隆（D错）为促尿酸排泄药。双氯芬酸（E错）不但能抑制前列腺素的合成，镇痛和抗炎，且能抑制尿酸盐结晶的吞噬，可作为急性期的基本用药，或在秋水仙碱疗效不好时作为替代药。